结核病人可根据其对异烟肼乙酰化代谢速度的快慢分为异烟肼慢代谢者和快代谢者。异烟肼慢代谢者服用相同剂量异烟肼，其血药浓度比快代谢者高，药物蓄积而导致体内维生素B₆缺乏，而异烟肼快代谢者则易发生药物性肝炎甚至肝坏死。白种人多为异烟肼慢代谢者，而黄种人多为异烟肼快代谢者。据此，对不同种族服用异烟肼呈现出不同不良反应的分析，正确的是
A. 异烟肼对白种人和黄种人均易引起肝损害
B. 异烟肼对白种人和黄种人均易诱发神经炎
C. 异烟肼对白种人易引起肝损害，对黄种人易诱发神经炎
D. 异烟肼对白种人和黄种人均不易诱发神经炎和引起肝损害
E. 异烟肼对白种人易诱发神经炎，对黄种人易引起肝损害

正确答案：E。异烟肼对白种人易诱发神经炎，对黄种人易引起肝损害

解析：本题考查影响药物的作用因素。由题干可知，白种人多为异烟肼慢代谢者，而黄种人多为异烟肼快代谢者，而异烟肼快代谢者则易发生药物性肝炎甚至肝坏死，慢代谢者则易诱发神经炎（E对）。